切面灰黑色或棕黑色，木部有4～10个类白色点状维管束排列成环的饮片是
A. 何首乌
B. 莪术
C. 白芍
D. 胡黄连
E. 绵马贯众

正确答案：D。胡黄连

解析：本题考查的是胡黄连饮片的性状鉴别。切面灰黑色或棕黑色，木部有4～10个类白色点状维管束排列成环的饮片是胡黄连（D对）。胡黄连：【性状鉴别】饮片为不规则的圆形薄片。外表皮灰棕色至暗棕色。切面灰黑色或棕黑色，木部有4～10个类白色点状维管束排列成环。气微，味极苦。何首乌（A错）：【性状鉴别】切片为不规则厚片或块。表面红棕色或红褐色，皱缩不平，有浅沟，并有横长皮孔样突起及细根痕。体重，质坚实，不易折断，切断面浅黄棕色或浅红棕色，显粉性，皮部有4～11个类圆形异形维管束环列，形成云锦花纹，中央木部较大，有的呈木心。气微，味微苦而甘涩。莪术（B错）：【性状鉴别】饮片呈类圆形或椭圆形厚片。外表皮灰黄色或灰棕色，有时可见环节或须根痕，切面黄绿色、黄棕色或棕褐色。内皮层环纹明显，散在“筋脉”小点。气微香，味微苦而辛。白芍（C错）：【性状鉴别】饮片多呈类圆形的薄片。表面淡棕红色或类白色。切面微带棕红色或类白色，形成层环明显，可见稍隆起的筋脉纹呈放射状排列。气微，味微苦、酸。绵马贯众（E错）：【性状鉴别】饮片呈不规则厚片或碎块，根茎外表面黄棕色至黑褐色，多被有叶柄残基，有的可见棕色鳞片，切面淡棕色至红棕色，有黄白色维管束小点，环状排列。气特异，味初淡而微涩，后渐苦、辛。